伤寒病程中阳性率最高的实验室检查是
A. 血培养
B. 尿培养
C. 骨髓培养
D. 粪便培养
E. 玫瑰疹刮取物培养

正确答案：C。骨髓培养

解析：伤寒骨髓培养：阳性率较血培养为高，可达90%。阳性率受病程及应用抗菌药的影响小，已开始抗菌治疗者仍可获阳性结果（C对）。